下列有关食物嵌塞的原因，说法不正确的是
A. 修复体轴面外形不良
B. （牙合）面形态不良
C. 修复体有悬突
D. 龈边缘不密合
E. 对（牙合）牙无充填式牙尖

正确答案：E。对（牙合）牙无充填式牙尖

解析：食物嵌塞的原因：①修复体与邻牙或修复体与修复体之间无接触或接触不良。②修复体轴面外形不良，如外展隙过大，龈外展隙过于敞开。③（牙合）面形态不良，边缘嵴过锐，颊舌沟不明显，食物排溢不畅。④（牙合）平面与邻牙不一致，形成斜向邻面的倾斜面。⑤邻面接触虽然良好，但修复体有悬突或龈边缘不密合。⑥对（牙合）牙有充填式牙尖（杵臼式牙尖）等。掌握“修复体戴入后的问题及处理”知识点。